38岁女性，活动后心悸气喘1年余，查体轻度贫血，心率快，律整，胸骨右缘第2肋间闻及响亮而粗糙的收缩期杂音（3/6级），首先应想到的疾病为
A. 动脉导管未闭
B. 主动脉瓣关闭不全
C. 二尖瓣关闭不全
D. 室间隔缺损
E. 主动脉瓣狭窄

正确答案：E。主动脉瓣狭窄

解析：患者中年女性，有活动后心悸气喘症状（心力衰竭症状），查体：胸骨右缘第2肋间闻及响亮而粗糙的收缩期杂音（3/6级）（主动脉瓣狭窄特征性杂音），首先应想到的疾病为主动脉瓣狭窄（E对）。动脉导管未闭（P274）（A错）的突出体征为胸骨左缘第二肋间及左锁骨下方的连续性机械样杂音；主动脉瓣关闭不全（P299）（B错）的心脏杂音为主动脉瓣区高调递减型叹气样舒张期杂音；二尖瓣关闭不全（P292）（C错）的典型杂音为心尖区全收缩期吹风样杂音，可伴有收缩期震颤；室间隔缺损（P273）（D错）沿胸骨左缘第3～4肋间可闻及Ⅳ-Ⅵ级全收缩期杂音伴震颤。